心理治疗的患者会爱上心理治疗师，心理治疗师也会对患者有感情
A. 移情与反移情
B. 正移情
C. 反移情
D. 负移情
E. 过分移情

正确答案：A。移情与反移情

解析：本题考查医患关系。心理治疗的患者会爱上心理治疗师，心理治疗师也会对患者有感情，属于移情与反移情（A对）。移情：患者角色的社会合理性，使部分患者以患者身份与医师保持长期的关系。在这种长期的医患关系中，医患关系成了患者生活中重要的关系，其代替了患者匮乏的人际关系和社会支持，患者无意识地将个人关系中的亲密关系和情感投射到医师身上；反移情：在医患关系中，医师除了从医师角色的视角对待患者外，医师个人无意识的需要、欲望、价值观等，有时也会无意识地投射到患者身上。例如在面对非常有吸引力的异性患者时，医师的思维可能会变得非理性起来，无意识地希望发展与患者更亲密的关系，使医患关系偏离职业关系，最终可能发展为个人之间的亲密关系。这是医师应该避免的。